小儿第一个生理弯曲出现是在
A. 3个月
B. 6个月
C. 9个月
D. 12个月
E. 6～7岁

正确答案：A。3个月

解析：3个月小儿抬头时出现颈椎前凸（第一个生理弯曲）。掌握“骨骼发育”知识点。